可用滴制法制备的剂型有
A. 软胶囊
B. 蜜丸
C. 浓缩丸
D. 滴丸
E. 蜡丸

正确答案：A、D。软胶囊；滴丸

解析：本题考查的是滴制法制备的剂型。可用滴制法制备的剂型有软胶囊（A对）与滴丸（D对）。软胶囊：系指将一定量的液体原料药物直接包封，或将固体原料药物溶解或分散在适宜的辅料中制备成溶液、混悬液、乳状液或半固体，密封于软质囊材中的胶囊剂。软胶囊又称胶丸，可用滴制法或压制法制备。按制法不同，丸剂可分为泛制丸、塑制丸与滴制丸。①泛制丸：系指药物细粉以适宜液体为润湿剂或黏合剂泛制而成的圆球形制剂，如水丸及部分水蜜丸、浓缩丸、糊丸等。②塑制丸：系指药物细粉与适宜黏合剂混合制成的可塑性丸块，经制丸机或丸模制成的丸剂，如蜜丸（B错）及部分糊丸、浓缩丸（C错）等。③滴制丸（滴丸）：用滴制法制成的丸剂，系指原料药与适宜的基质加热熔融混匀，滴入不相混溶、互不作用的冷凝介质中制成的球形或类球形制剂。蜡丸（E错）的制备方法，2022年考试指南未明确说明。